能使细胞获得抗病毒能力的细胞因子
A. 白细胞介素
B. 干扰素
C. 肿瘤坏死因子
D. 集落刺激因子
E. 趋化因子

正确答案：B。干扰素

解析：干扰素（IFN）因能干扰病毒在宿主细胞内复制而得名，是能使细胞获得抗病毒能力的细胞因子。掌握“细胞因子及受体”知识点。